10个月的婴儿，虚胖，毛发稀疏发黄，面色及口腔黏膜苍白，表情淡漠。运动发育落后。该患儿一直母乳喂养；尚未添加辅食。首选的实验室或辅助检查是
A. 腕部X线片
B. 脑电图
C. 肝功
D. 血红蛋白
E. 血钙

正确答案：D。血红蛋白